属于医师执业权利的是
A. 医师在执业活动中人格尊严人身安全不受侵犯
B. 医师在执业活动中应当遵守法律法规遵守技术操作规范
C. 对医学专业技术有重大突破，作出显著贡献的医师，应当给予表彰或者奖励
D. 医师应当使用经国家有关部门批准使用的药品。消毒药剂和医疗器械
E. 对考核不合格的医师。可以责令其接受培训和继续医学教育

正确答案：A。医师在执业活动中人格尊严人身安全不受侵犯

解析：《执业医师法》规定了执业医师的权利、义务、考核与培训以及法律责任等，其中在执业活动中，人格尊严、人身安全不受侵犯（A对）属于医师在执业活动中应享有的权利。医师在执业活动中应当遵守法律法规遵守技术操作规范（B错）属于医师在执业活动中应履行的义务。对医学专业技术有重大突破，作出显著贡献的医师，应当给予表彰或者奖励（C错）不属于《执业医师法》的规定内容。医师应当使用经国家有关部门批准使用的药品、消毒药剂和医疗器械（D错）属于医师执业过程中不不可违反的执业规则，否则应承担相应的法律责任。对考核不合格的医师，相关部门可以责令其接受培训和继续医学教育（E错）属于《执业医师法》规定的医师考核与培训制度的相关内容。